体温昼夜变化的特点是
A. 昼夜间呈现周期性波动
B. 清晨及午后体温均较高
C. 傍晚体温最低
D. 波动幅度在2℃以上
E. 体温波动与生物钟无关

正确答案：A。昼夜间呈现周期性波动